头孢类药物作用机制是
A. 抑制细菌蛋白质合成
B. 抑制细菌代谢
C. 干扰细菌核酸代谢
D. 抑制细菌细胞壁合成
E. 干扰真菌细胞膜功能

正确答案：D。抑制细菌细胞壁合成

解析：本题考查头孢类的作用机制。头孢菌素类作用机制为抑制细菌细胞壁合成（D对）。氨基糖苷类、林可霉素类作用机制为抑制细菌蛋白质的合成（A错）。磺胺类抗菌药物的作用机制为抑制细菌代谢（B错）。喹诺酮类药物的作用机制为干扰细菌核酸代谢（C错）。抗真菌药两性霉素B能干扰真菌细胞膜功能（E错）。